患儿，3岁。发热第4天，细小红色疹点自耳后发际起，发展至面、颈、躯干、四肢，咳嗽声重，有如犬吠，声音嘶哑，咽喉肿痛，舌红苔黄腻。治疗应首选
A. 清咽下痰汤
B. 清金化痰汤
C. 竹沥达痰丸
D. 解肌透痧汤
E. 化斑解毒汤

正确答案：A。清咽下痰汤

解析：患儿发热第4天，细小红色疹点自耳后发际起，发展至面、颈、躯干、四肢，当属麻疹，其以发热恶寒，咳嗽咽痛，鼻塞流涕，泪水汪汪，畏光羞明，麻疹黏膜斑，周身皮肤按序布发麻粒样大小的红色斑丘疹为特征，麻疹时邪内陷袭肺，灼津炼液成痰，痰热壅盛，肺气失宣，则见咳嗽，有如犬吠，夹痰上攻咽喉，则见咽喉肿痛，舌红苔黄腻为邪毒夹痰热上攻之象，治以清咽下痰汤，可清热解毒，利咽消肿（A对）。清金化痰汤善治咳嗽，咯痰黄稠腥臭，咽喉干痛，舌苔黄腻，脉象濡数者（B错）。竹沥达痰丸善治痰热上壅，顽痰胶结，咳喘痰多，烦闷癫狂（C错）。解肌透痧汤主治邪犯肺卫的猩红热，症见发热，咽喉红肿疼痛，皮肤潮红，痧疹隐现（D错）。化斑解毒汤治疗三焦风热上攻，致生火丹，延及全身痒痛者（E错）。